DIC消耗性低凝期首选
A. 肝素
B. 输新鲜血浆
C. 输新鲜全血
D. 氨基已酸
E. 输浓缩血小板

正确答案：B。输新鲜血浆

解析：DIC（弥散性血管内凝血）分为三期，早期由于凝血酶激活，微血栓形成，机体处于高凝状态；中期由于凝血因子大量消耗，机体处于消耗性低凝状态；晚期可继发纤溶亢进。消耗性低凝状态首选输新鲜血浆（B对），补充凝血因子；DIC早期（高凝期）应尽早使用肝素（A错），终止DIC病理过程，减轻器官损伤，重建凝血-抗凝血平衡；DIC纤溶亢进期应采用氨基已酸（P611）（D错）等纤溶抑制药物，减轻出血；输浓缩血小板（P627）（E错）主要用于血小板减少患者，以预防出血；输新鲜全血（C错）可用于休克的治疗。